能够杀灭各型阿米巴原虫，适于肠内、外急慢性阿米巴病的药物为
A. 氯喹
B. 卡巴肿
C. 痢特灵
D. 甲硝咪唑
E. 吐根碱

正确答案：D。甲硝咪唑

解析：能够杀灭各型阿米巴原虫，适于肠内、外急慢性阿米巴病的药物为甲硝咪唑（D对），硝基咪唑类对阿米巴滋养体有强大杀灭作用，是目前治疗肠内、外各型阿米巴病的首选药物。